某搬运工，男性。工龄5年。1年来腰部经常疼痛，弯腰、转身等活动受限，经内科和X线检查均未发现异常。这种情况应考虑的诊断
A. 职业病
B. 全身振动病
C. 职业性下背痛
D. 骨质增生
E. 风湿病

正确答案：C。职业性下背痛